动脉血PCO₂在40-60mmHg范围内升高时，呼吸运动的改变是
A. 幅度变深，频率变快
B. 幅度变浅，频率变快
C. 幅度变深，频率变慢
D. 幅度变浅，频率变慢
E. 幅度变深，频率不变

正确答案：A。幅度变深，频率变快

解析：动脉血PCO₂在40～60mmHg范围内升高时，可刺激呼吸运动加深加快，即幅度变深，频率变快（A对），使肺泡通气量增加，从而促进CO₂的排出。但当血PCO₂过高时，对呼吸中枢的活动起抑制作用，会出现CO₂麻醉。